患者烦渴多饮，多尿达8L/24h，尿比重为1.003最可能的疾病是
A. 糖尿病
B. 尿崩症
C. 慢性肾炎
D. 心功能不全
E. 肾病综合征

正确答案：B。尿崩症

解析：超过2500mL/d称为多尿，尿崩症患者尿量多可达4～20L/d，比重常在1.005以下，部分性尿崩症患者尿比重有时可达1.010（B对）。糖尿病尿糖常为阳性，酮症或酮症酸中毒时尿酮体阳性（A错）。蛋白尿是诊断慢性肾炎的主要依据，尿沉渣可见颗粒管型和透明管型。多数可有镜下血尿、少数病人可有间发性肉眼血尿（C错）。右心功能不全可出现尿量减少、夜尿增多（D错）。肾病综合征以大量蛋白尿为主要特点，可出现脂肪尿、管型尿等（E错）。